下列实验室检查结果支持阵发性睡眠性血红蛋白尿诊断的是
A. 酸溶血（Ham）试验阳性
B. 抗人球蛋白（Coombs）试验阳性
C. 红细胞渗透性增高
D. 血红蛋白电泳异常
E. 高铁血红蛋白还原试验阳性

正确答案：A。酸溶血（Ham）试验阳性

解析：阵发性睡眠性血红蛋白尿患者由于红细胞膜缺陷导致红细胞对补体敏感性增高，红细胞易被补体破坏。其经典的确诊试验是酸溶血试验（Ham试验）阳性（A对），具有特异性。抗人球蛋白试验（Coombs）试验阳性（P558）（B错）是温抗体型自身免疫性溶血性贫血最具诊断意义的实验室检查；红细胞渗透脆性增高（P553）（C错）主要用于遗传性球形红细胞增多症的诊断；血红蛋白电泳异常（P556）（D错）主要用于地中海贫血等血红蛋白病的诊断；高铁血红蛋白还原试验阳性（P554）（E错）主要用于红细胞葡萄糖-6-磷酸脱氢酶（G6PD）缺乏症的诊断。